简略寿命表的编制是根据某一人群的（）计算的一种统计图表
A. 总死亡率
B. 因某病的年龄组死亡率
C. 年龄组死亡率
D. 终寿区间成数
E. 性别死亡率

正确答案：C。年龄组死亡率

解析：本题考查简略寿命表的编制。简略寿命表的编制是根据某一人群的年龄组死亡率（C对ABDE错）计算的一种统计图表。